药物信息包括药事法规和药品价格，这说明药物信息
A. 紧密结合临床
B. 内容广泛多样
C. 更新传递快速
D. 做到去伪存真
E. 提高药学水平

正确答案：B。内容广泛多样